对于林可霉素类抗生素的抗菌作用下列说法正确的是
A. 林可霉素的抗菌活性比克林霉素强4～8倍
B. 对人型支原体无作用
C. 对沙眼衣原体无抑制作用
D. 对肠球菌、肺炎支原体敏感
E. 对厌氧菌有强大抗菌作用

正确答案：E。对厌氧菌有强大抗菌作用

解析：克林霉素的抗菌活性比林可霉素强4～8倍。最主要特点是对各类厌氧菌有强大的抗菌作用。对人型支原体和沙眼衣原体也有抑制作用，但肠球菌、肺炎支原体对本类药物不敏感。掌握“红霉素及林可霉素”知识点。